正常新生儿生后第一年中身高增长约
A. 35cm
B. 32cm
C. 30m
D. 27cm
E. 25cm

正确答案：E。25cm

解析：正常新生儿生后第一年中身高增长约25cm（E对）。